下列各项中，不利于医院整体效应发挥的是群体间的
A. 互补
B. 师承
C. 控制
D. 离心
E. 合作

正确答案：D。离心

解析：互尊互学、团结协作是正确处理同事、同行之间医际关系的医德准则。只有这样，才有利于医学事业的发展，有利于医院整体效应的发挥。医院整体效应的发挥依赖于群体间的互补（A对）、师承（B对）、控制（C对）、合作（E对），群体间的离心（D错，为本题正确答案）即不团结，不利于医院整体效应发挥。